结核性淋巴结炎好发于
A. 婴幼儿
B. 儿童及青年
C. 中年男性
D. 老年人
E. 体弱多病者

正确答案：B。儿童及青年

解析：结核性淋巴结炎常见于儿童及青年。轻者仅有淋巴结肿大而无全身症状；重者可伴体质虚弱、营养不良或贫血，或有低热、盗汗、疲倦等症状，并可同时有肺、肾、肠、骨等器官的结核病变或病史。掌握“面颈部淋巴结炎”知识点。